血友病A是缺乏下列哪种凝血因子
A. Ⅶ
B. Ⅷ
C. Ⅸ
D. Ⅹ
E. Ⅺ

正确答案：B。Ⅷ

解析：血友病A是一种X染色体连锁的凝血因子Ⅷ量和分子结构异常引起的隐性遗传性出血性疾病。掌握“血友病”知识点。